五味子具有
A. 中枢兴奋作用
B. 中枢抑制作用
C. 二者均是
D. 二者均不是

正确答案：D。二者均不是

解析：本题考查的是五味子的药理作用。五味子具有保肝作用（D对）。五味子的保肝作用，与其功效之间存在差异性。中枢兴奋作用（A错）与中枢抑制作用（B错）为人参的药理作用。人参具有兴奋和抑制中枢作用，其所含的皂苷就有Ra₁、Rb₁、Rc、Rd、Rg₁、Re、Rf、Rh₁、Ro等20多种，其中Rg类有中枢兴奋作用，而Rb类则有中枢抑制作用。人参还具有调节血糖的作用，对糖尿病动物的高血糖有降低作用，而对注射胰岛素诱发的血糖降低则有回升作用，主要成分与人参皂苷、人参多糖、人参多肽有关。